男孩，6岁。头痛、呕吐，站立不稳、行走左右摇晃2个月。查体：神志清楚，精神差，双侧视乳头水肿。最可能的诊断是
A. 顶叶恶性淋巴瘤
B. 枕叶星形细胞瘤
C. 小脑髓母细胞瘤
D. 矢状窦旁脑膜瘤
E. 颞叶胶质母细胞瘤

正确答案：C。小脑髓母细胞瘤

解析：儿童男性患者，头痛、呕吐（颅内压增高的表现），站立不稳、行走左右摇晃2个月（共济失调的表现）。查体：神志清楚，精神差，双侧视乳头水肿。最可能的诊断是小脑髓母细胞瘤（C对）。顶叶恶性淋巴瘤（A错）好发于50～60岁左右的老年人。枕叶星形细胞瘤（B错）生长缓慢，平均病史2～3年，病情呈缓慢进行性发展癫痫常为首发症状。矢状窦旁脑膜瘤（D错）平均高发年龄45 岁。颞叶胶质母细胞瘤（E错）生长速度快，70％～80％患者病程在3～6个月。